将蛋白质类食物通过胃瘘直接放入胃内引起胃液分泌的特点是
A. 量大、酸度高、消化力较弱
B. 量大、酸度高、消化力较强
C. 量大、酸度低、消化力较强
D. 量小、酸度低、消化力较弱
E. 量小、酸度低、消化力较强

正确答案：B。量大、酸度高、消化力较强